治疗腹痛饮食积滞重证，应首选
A. 保和丸
B. 越鞠丸
C. 枳实导滞丸
D. 枳术丸
E. 木香顺气散

正确答案：C。枳实导滞丸

解析：腹痛饮食积滞证临床表现为脘腹胀满，疼痛拒按，嗳腐吞酸，厌食呕恶，痛而欲泻，泻后痛减，或大便秘结；舌苔厚腻，脉滑。治宜消食导滞，理气止痛。方选枳实导滞丸（C对）。保和丸功用消食化滞，理气和胃，主治食积证，饮食积滞型腹痛轻证可以保和丸（A错）。越鞠丸功效行气解郁，主治六郁证（B错）。枳术丸功用健脾消痞，主治脾虚气滞，饮食停积证（D错）。木香顺气散功效开郁化滞，行气止痛，主治气滞不舒，肝胃不和，腹胁胀满或胀痛，胸闷食少，大便不利（E错）。